T1乳腺癌其肿块最长径不超过
A. 1cm
B. 2cm
C. 3cm
D. 4cm
E. 5cm

正确答案：B。2cm